原动物属于壁虎科的药材是
A. 蛤蚧
B. 蜈蚣
C. 桑螵蛸
D. 海螵蛸
E. 石决明

正确答案：A。蛤蚧

解析：本题考查的是蛤蚧的来源。原动物属于壁虎科的药材是蛤蚧（A对）。蛤蚧：【来源】为脊索动物门爬行纲壁虎科动物蛤蚧除去内脏的干燥体。蜈蚣（B错）：【来源】为节肢动物门多足纲蜈蚣科动物少棘巨蜈蚣的干燥体。桑螵蛸（C错）：【来源】为节肢动物门昆虫纲螳螂科昆虫大刀螂、小刀螂或巨斧螳螂的干燥卵鞘。海螵蛸（D错）：【来源】为软体动物门乌贼科动物无针乌贼或金乌贼的干燥内壳。石决明（E错）：【来源】为软体动物门鲍科动物杂色鲍（九孔鲍）、皱纹盘鲍、羊鲍、澳洲鲍、耳鲍或白鲍的贝壳。